长期大量服用维生素C可出现
A. 颅内压上升
B. 肢端肥大
C. 乳腺肿大
D. 尿频和腹泻
E. 肝肾损害和骨骼硬化

正确答案：D。尿频和腹泻

解析：本题考查维生素的不良反应。维生素C毒性较小，偶见腹泻、皮肤红亮、头痛、尿频（D对）等。长期大量服用维生素A可引起慢性中毒，出现颅内压增高（A错）、发热、夜尿增多、毛发干枯或脱落、皮肤干燥或瘙痒、体重减轻、四肢疼痛、贫血、眼球突出、剧烈头痛等现象。大量服用维生素E可引起视物模糊、乳腺肿大（C错）、类流感样综合征、胃痉挛、疲乏、软弱。长期大量服用维生素D可出现肾脏损害、低热、惊厥、厌食、肝脏肿大，骨硬化等症（E错）。成年人长期使用生长激素类药物可引起肢端肥大症（B错）。